前纵韧带
A. 为连接相邻两椎弓的韧带
B. 可防止椎间盘向后脱出
C. 可防止脊柱过伸
D. 细长，上起自枢椎
E. 无

正确答案：C。可防止脊柱过伸

解析：前纵韧带位于椎体前面，并不能防止椎间盘向后突出（B错）。上端起自枕骨大孔前缘（D错），下端抵达第1或第2骶椎，可以防止脊柱过伸（C对）。连接相邻两椎弓的韧带是黄韧带（A错）。